取粉末少量，用微火灼烧，有紫红色烟雾发生的药材是
A. 海金沙
B. 青黛
C. 冰片
D. 儿茶
E. 五倍子

正确答案：B。青黛

解析：本题考查的是青黛的性状鉴别。取粉末少量，用微火灼烧，有紫红色烟雾发生的药材是青黛（B对）。青黛：【性状鉴别】药材为深蓝色的粉末，体轻，易飞扬；或呈不规则多孔性的团块、颗粒，用手搓捻即成细末。微有草腥气，味淡。取本品少量，用微火灼烧，有紫红色烟雾发生。取本品少量，滴加硝酸，产生气泡并显棕红色或黄棕色。海金沙（A错）：【性状鉴别】药材呈粉末状，棕黄色或浅棕黄色。体轻，手捻有光滑感，置手中易由指缝滑落。气微，味淡。将海金沙粉末撒在水中则浮于水面，加热始逐渐下沉；将其少量撒于火上，即发出轻微爆鸣及明亮的火焰。冰片（C错）：【性状鉴别】药材为无色透明或白色半透明的片状松脆结晶。气清香，味辛、凉。具挥发性，点燃发生浓烟，并有带光的火焰。本品在乙醇、三氯甲烷或乙醚中易溶，在水中几乎不溶。熔点为205℃～210℃。儿茶（D错）：【性状鉴别】药材呈方形或不规则块状，大小不一。表面棕褐色或黑褐色，光滑而稍具光泽。质硬，易碎，断面不整齐，具光泽，有细孔，遇潮有黏性。气微，味涩、苦，略回甜。五倍子（E错）：【性状鉴别】药材肚倍呈长圆形或纺锤形囊状。表面灰褐色或灰棕色，微有柔毛。质硬而脆，易破碎，断面角质样，有光泽，内壁平滑，有黑褐色死蚜虫及灰色粉末状排泄物。气特异，味涩。